关于抗抑郁药氟西汀性质的说法，正确的是
A. 氟西汀为三环类抗抑郁药物
B. 氟西汀为选择性的中枢5-HT再摄取抑制剂
C. 氟西汀体内代谢产物无抗抑郁活性
D. 氟西汀口服吸收较差，生物利用度低
E. 氟西汀结构中不具有手性中心

正确答案：B。氟西汀为选择性的中枢5-HT再摄取抑制剂

解析：本题考查5-羟色胺（5-HT）再摄取抑制剂氟西汀。关于抗抑郁药氟西汀性质的说法，正确的是氟西汀为选择性的中枢5-HT再摄取抑制剂（B对）。氟西汀为非三环类的抗抑郁药（A错），其为选择性的5-羟色胺重摄取抑制剂，通过选择性地抑制中枢神经系统对5-HT的再吸收，延长和增加5-HT的作用。氟西汀在体内代谢成去甲氟西汀，去甲氟西汀与原药活性相同（C错），但由于半衰期很长，会产生药物积蓄及排泄缓慢的现象。氟西汀的口服吸收良好（D错），生物利用度达100%，t1/2为70小时，是长效的口服抗抑郁药。氟西汀含有手性碳（E错），S异构体的活性较强，临床使用外消旋体。